孕妇使用可引起视神经损害，智力障碍和惊厥
A. 甲巯咪唑
B. 硫酸镁
C. 氯丙嗪
D. 氯喹
E. 氯化钾

正确答案：D。氯喹

解析：本题考查妊娠期妇女用药。妊娠期使用氯喹（D对）可引起视神经损害、智力障碍和惊厥。